食品安全风险评估结果由（）公布
A. 国务院卫生行政部门
B. 省、自治区、直辖市人大常委会
C. 省级卫生行政部门
D. 县级卫生行政部门
E. 省、自治区、直辖市人民政府

正确答案：A。国务院卫生行政部门